短暂性脑缺血发作应用阿司匹林治疗的目的是
A. 改善神经功能的缺失
B. 保护脑细胞
C. 增加再灌注
D. 预防复发
E. 扩张血管

正确答案：D。预防复发

解析：短暂性脑缺血发作（TIA）是由于血流动力学改变、微栓塞等原因导致局部脑或视网膜缺血引起的短暂性神经功能缺失。阿司匹林抗血小板治疗对于非心源性栓塞性TIA可以起到抗血小板凝集、防止再次阻塞动脉引起血流动力学障碍的作用，因而可以预防TIA的复发（D对）。阿司匹林是抗血小板凝集药，不能改善神经功能的缺失（A错）、无保护脑细胞（B错）和扩张血管（E错）的作用。增加再灌注（C错）是溶栓药的作用。